深龋近髓的乳牙选择的治疗方法是
A. 直接垫底后充填
B. 牙髓切断术
C. 干髓术
D. 间接盖髓术
E. B或C

正确答案：D。间接盖髓术

解析：本题考查乳牙牙髓治疗的方法。间接牙髓治疗即间接盖髓术是指在治疗深龋近髓患牙时，为避免露髓，有意识地保留洞底近髓的部分龋坏牙本质，用氢氧化钙等生物相容性材料覆盖龋坏牙本质，以抑制龋病发展，促进龋坏牙本质再矿化，保存牙髓活力。因此深龋近髓的乳牙选择的治疗方法应是间接盖髓术（D对）。直接垫底后充填（A错）是不可取的，因为垫底前备洞时容易露髓，不利于牙髓的保存。牙髓切断术（B错）适用于深龋已露髓的乳牙。干髓术（C错）可用于乳牙牙髓炎的治疗，但常发生牙根过早吸收，并发根尖周炎等情况。